肉豆蔻除了治疗久泻久痢外，还可治疗
A. 肾虚喘息
B. 虚汗不止
C. 肾虚遗精
D. 肺虚久咳失音
E. 虚寒气滞，脘腹胀痛

正确答案：E。虚寒气滞，脘腹胀痛

解析：本题考查的是肉豆蔻的主治病证。肉豆蔻除了治疗久泻久痢外，还可治疗虚寒气滞，脘腹胀痛（E对）。肉豆蔻：【主治病证】（1）久泻不止。（2）虚寒气滞之脘腹胀痛、食少呕吐。山茱萸：【主治病证】（1）肝肾亏虚之头晕目眩、腰膝酸软、阳痿。（2）肾虚之遗精、滑精，小便不禁，虚汗不止（B错）。（3）妇女崩漏及月经过多。莲子肉：【主治病证】（1）脾虚久泻、食欲不振。（2）肾虚遗精（C错）、滑精，脾肾两虚之带下。（3）心肾不交之虚烦、惊悸失眠。诃子：【主治病证】（1）久泻，久痢，便血脱肛。（2）肺虚久咳，咽痛，失音（D错）。主治病证为肾虚喘息（A错）的中药，2022年考试指南未明确说明。